男，28岁。右上腹撞伤后腹痛2小时。查体：P140次/分，R24次/分，BP80/40mmHg，神志清，面色苍白，双肺呼吸音清，腹部膨隆，腹式呼吸减弱，全腹压痛，以右上腹为著，伴反跳痛，肝区叩痛（+），肝浊音界无缩小。腹穿抽出不凝固血。血常规Hb78g/L,WBC13.5×10⁹/L,N0.68,Plt135×10⁹/L。最可能的诊断是
A. 脾破裂
B. 右肾裂伤
C. 小肠破裂
D. 肝破裂
E. 横结肠破裂

正确答案：D。肝破裂

解析：患者右上腹撞伤后腹痛2小时（右上主要实质性脏器为肝脏）。查体：P140次／分（心率快），R24次／分（呼吸频率快），BP80/40mmHg（血压低，考虑肝脏损伤，腹腔内出血，导致失血性休克），神智清，面色苍白，双肺呼吸音清，腹部膨隆，腹式呼吸减弱，全腹压痛，以右上腹为著，伴反跳痛，肝区叩诊（＋），考虑肝脏损伤（D对）。脾破裂（A错）出血不会迅速出现反跳痛因为血液引起腹膜刺激征较轻。右肾损伤（B错）表现为右腰部，不会出现全腹压痛反跳痛，且多有泌尿系统症状。闭合性损伤导致的小肠破裂（C错）早期症状体征多不明显。横结肠破裂（E错）会有较重的感染。